甲状腺
A. 位于舌骨下肌群的前面
B. 仅由两个侧叶组成
C. 其前面附有甲状旁腺
D. 两个侧叶间连有甲状腺峡
E. 质地较硬

正确答案：D。两个侧叶间连有甲状腺峡

解析：甲状腺是人体最大的内分泌腺，为红褐色腺体，呈H形，由左、右侧叶和中间的甲状腺峡组成（B错）。甲状腺左、右侧叶的后面附有甲状旁腺（C错）。两个侧叶间连有甲状腺峡（D对）。